下列关于针刺四缝操作程序的叙述，错误的是
A. 握持患儿手指
B. 皮肤局部消毒
C. 用粗毫针针刺
D. 刺入人指关节腔
E. 出针挤出粘液

正确答案：D。刺入人指关节腔

解析：四缝是经外奇穴，针刺四缝可以清热、除烦、通畅百脉、调和脏腑等，常用于治疗疮证和厌食，在操作过程中，只需刺约一分深，不需刺入人指关节腔（D错，为本题的正确答案）。握持患儿手指以便固定，防止患儿翻动，防止患儿受伤及方便操作（A对）。皮肤局部消毒以防感染（B对）。选用针具为三棱针，用粗毫针亦可代替（C对）。刺后用手挤出粘液以让邪气有出路（E对）。